盐酸美他环素“杂质的吸收”的检查项目主要是控制
A. 土霉素
B. 水分
C. 差向异构体
D. 脱水美他环素
E. 氯化物

正确答案：C、D。差向异构体；脱水美他环素